下列除哪项外均可为正常的叩诊音
A. 振水音
B. 清音
C. 鼓音
D. 浊音
E. 实音

正确答案：A。振水音

解析：胸部叩诊音可分为清音（B对）、过清音、鼓音（C对）、浊音（D对）和实音（E对）。自斜方肌前缘中央部开始叩诊为清音，逐渐叩向外侧，至肺上界外侧终点时，叩诊由清音变为浊音，叩诊心脏及肝脏等实质性器官时为实音。叩诊胃泡区和腹部时为鼓音。振水音（A错，为本题正确答案）见于幽门梗阻及胃扩张。